气脱属于
A. 气的升降失常
B. 气的出入异常
C. 气的运行障碍
D. 元气牦损
E. 气的生成障碍

正确答案：B。气的出入异常

解析：气脱指气不内守，大量向外脱失，以致机体功能突然衰竭的病机变化，属气的出入异常（B对）。气陷指气的上升不足或下降太过，以气虚升举无力而下陷为特征的病机变化，输气的升降失常（A错）。气滞指气的运行不畅，郁滞不通的病机变化，属气的运行障碍（C错）。元气是人身最根本、最重要的气，是生命活动的原动力，元气亏虚可引起全身性气虚（D错）。气虚指一身之气不足，而表现出相应功能减退的病机变化，气虚的形成主要由于先天禀赋不足，或后天失养，肺脾肾的功能失调，而致气的生成不足，以及因劳倦内伤，救兵不复等使气过多消耗而致（E错）。